预防性树脂充填没有下列哪一个操作
A. 去除窝沟处的病变牙釉质或牙本质
B. 采用预防性扩展备洞方法
C. 采用酸蚀技术
D. 采用树脂材料充填
E. 在（牙合）面上涂一层封闭剂

正确答案：B。采用预防性扩展备洞方法

解析：本题考查预防性树脂充填。预防性树脂充填术时只需去除窝沟处的病变牙釉质或牙本质，不需要采用预防性扩展备洞方法（B错，为本题的正确答案）。预防性树脂充填术是对已经发生或可疑龋坏的患牙，磨开窝沟，去除窝沟处的病变牙釉质或牙本质（A对）并备洞，采用酸蚀技术（C对）和树脂材料充填（D对）龋洞并在牙面上涂一层封闭剂（E对），是一种窝沟封闭与窝沟龋充填相结合的预防性措施，其临床操作步骤包括清洁牙面、隔湿、酸蚀、充填、涂布及固化封闭剂。